机体对外源性化学物质作用过程包括
A. 吸收和分布
B. 吸收和代谢
C. 代谢和排泄
D. 吸收和排泄
E. 吸收、分布和排泄

正确答案：E。吸收、分布和排泄